回肠
A. 占小肠远侧的2/3
B. 肠系膜内的脂肪比空肠少
C. 管径细、壁厚
D. 系膜内动脉弓少
E. 粘膜内有孤立、集合淋巴滤泡

正确答案：E。粘膜内有孤立、集合淋巴滤泡

解析：回肠占小肠远侧的3/5(A错)，肠系膜内脂肪比空肠多(B错)，管径细、壁薄(C错)，系膜内动脉弓数较多(D错)，回肠粘膜内有孤立和集合淋巴滤泡(E对)。